药物变性的含义是
A. 指由药物的治疗作用所引起的不良反应
B. 指药物有效成分降解产生有害物质
C. 指由遗传因素人体产生的不良反应
D. 指由抗原抗体的相互作用引起的不良反应
E. 指某些药物因被反复应用导致使用者瘾癖的特性

正确答案：B。指药物有效成分降解产生有害物质